流脑
A. 受感染的人作为传染源
B. 受感染的动物作为传染源
C. 两者都是
D. 两者都不是

正确答案：A。受感染的人作为传染源

解析：本题考查流行性脑脊髓膜炎的传染源。流行性脑脊髓膜炎是以隐性感染为主的传染病，主要传染源为受感染的人（A对BCD错）。